关于颞下颌关节滑膜炎的治疗下列说法正确的是
A. 口服阿片类镇痛药
B. 泼尼松龙混悬液0.5ml加入2%利多卡因0.5～1ml进行局部封闭
C. 硬化剂5%鱼肝油酸钠0.25～0.5ml作关节腔内注射
D. 使用2%普鲁卡因2ml关节腔内注射
E. 2%普鲁卡因5ml扳机点封闭

正确答案：B。泼尼松龙混悬液0.5ml加入2%利多卡因0.5～1ml进行局部封闭

解析：滑膜炎：口服非甾体类抗炎镇痛药物（如双氯芬酸钠或美洛昔康）、理疗、关节封闭治疗（泼尼松龙混悬液0.5ml加入2%利多卡因0.5～1ml注射于关节上腔。一般第二次关节腔内注射泼尼松龙需待3个月之后，以1～2次为宜）。掌握“颞下颌关节紊乱”知识点。